针对牙周病的病因采取的干预措施属于
A. 基本急诊保健
B. 牙周病一级预防
C. 牙周病二级预防
D. 牙周病三级预防
E. 社区牙周保健

正确答案：B。牙周病一级预防

解析：一级预防包括所有针对牙周病的病因采取的干预措施。掌握“牙周病流行病学及分级预防”知识点。